男，30岁，约一年时间孤僻寡言，近期由于被上级批评后出现失眠，不上班并紧闭门窗，声称有人监视自己，在家中不敢谈话，说家中已被安装窃听器，公安局也要逮捕自己，不吃妻子做的饭食，认为妻子已同他人合伙在饭菜中放了毒药。因此殴打妻子。本病例最可能的诊断是
A. 精神分裂症紧张型
B. 精神分裂症偏执型
C. 抑郁症
D. 反应性精神病
E. 躁狂症

正确答案：B。精神分裂症偏执型

解析：该病例患者为青年男性，起病较缓慢，从有人监视自己到妻子与同伙人下毒（对象渐趋泛化，内容日益荒诞的妄想）为主要表现，故诊断为精神分裂症偏执型（B对）。精神分裂症紧张型起病较急，常表现紧张性兴奋和紧张性木僵交替出现，亦可单独发生，以木僵最为多见，幻觉妄想少见（A错）。抑郁症以显著而持久的情感低落（忧愁、苦闷、唉声叹气、暗自落泪）为主要表现，本例无此症状，故不考虑（C错）。反应性精神病有明显的精神刺激，病程一般不长，精神症状内容可以被理解，无对象渐趋泛化，内容日益荒诞的妄想，与本例不符（D错）。躁狂症具有情感高涨、思维奔逸、活动增多“三高”的典型症状，本例无此症状，故不考虑（E错）。